下列检查中，适用于筛查轻微肝性脑病的检查是
A. 头颅MRI
B. 数字连接试验
C. 血氨
D. 头颅CT
E. 脑电图

正确答案：B。数字连接试验

解析：轻微肝性脑病无行为、性格的异常，无神经系统病理征，脑电图正常，只在心理测试或智力测试时有异常。因此适用于筛查轻微肝性脑病的检查是数字连接试验（B对）。脑电图（E错）无异常。